精确判断牙周袋是否存在的检查方法
A. 视诊、有无牙龈肿胀
B. 视诊、牙龈颜色有无变化
C. 咬合检查
D. 牙周探诊检查
E. X线片检查

正确答案：D。牙周探诊检查

解析：本题考查牙周组织检查。牙周探诊能探查牙周袋的有无、部位、深浅、类型、附着丧失程度、袋内牙石菌斑量及是否有根分叉病变。当探诊深度超过3mm且牙周袋底在釉牙本质界下、有附着丧失、牙槽骨吸收说明有牙周袋，所以精确判断牙周袋是否存在的检查方法是牙周探诊检查（D对）。视诊、有无牙龈肿胀（A错）只能检查出牙龈是否有炎症，不能看出是否有牙周袋。视诊、牙龈颜色有无变化（B错）只能通过牙龈颜色改变观察出牙龈是否有炎症或纤维性增生，不能看出牙周袋的有无。咬合检查（C错）只能检查出是否有（牙合）创伤或是否有根尖周病，不能检查出是否有牙周袋。X线片检查（E错）只能看出牙槽骨的吸收情况，有牙槽骨吸收证明有牙周袋形成，但假性牙周袋牙槽骨未吸收只通过X线片无法判断是否存在假性牙周袋。